某男，70岁，患糖尿病10年，长期服用西药降糖药，血糖稳定。今日听人介绍，又自行加服了中成药消渴丸。2日后，出现低血糖反应，遂去医院就诊。进入冬季，患者加服中药膏方调补，一段时间后，出现血糖波动，时有升高，分析其原因，是与其所服膏方中的某些中药有关，下列中药，能使血糖升高的药组是
A. 鹿茸、甘草
B. 麦冬、沙参
C. 天冬、赤芍
D. 肉苁蓉、肉桂
E. 制首乌、熟地黄

正确答案：A。鹿茸、甘草

解析：本题考查的是能够升高血糖的药组。能使血糖升高的药组是鹿茸、甘草（A对）。患有糖尿病的心脑血管患者用培元通脑胶囊、益心通脉颗粒、活血通脉片等含有甘草、人参、鹿茸等成分的中成药，可使降糖药的疗效降低。因为，甘草、人参、鹿茸具有糖皮质激素样作用，可以促进糖原异生，升高血糖，与降糖药二甲双胍、消渴丸、阿卡波糖和胰岛素产生拮抗作用，导致降糖效果降低。